下列各项，不属胎盘功能检查的是
A. 孕妇尿中雌三醇值
B. 缩宫素激惹试验
C. 孕妇尿中hCG值
D. 孕妇血清胎盘生乳素值
E. 阴道脱落细胞检查

正确答案：C。孕妇尿中hCG值

解析：妇女尿液中人类绒毛膜促性腺激素（HCG）的水平（C错，为本题正确答案），临床用于诊断早孕，可用于辅助诊断宫外孕，估计先兆流产和预后，在非妊娠期并可协助诊断并随访观察某些恶性肿瘤，在妊娠期HCG的生理作用尚不完全明了。胎盘功能检查包括：胎动，孕妇尿雌三醇值（A对），测定孕妇血清人胎盘生乳素值（D对）、缩宫素激惹试验（B对），阴道脱落细胞检查（E对），胎儿生物物理监测。